应加强护理，注意保暖，预防各种感染
A. 胎儿期
B. 新生儿期
C. 婴儿期
D. 幼儿期
E. 学龄前期

正确答案：B。新生儿期

解析：本题考查小儿年龄分期。新生儿期（B对）应加强护理，注意保暖，细心喂养，预防各种感染。